男，28岁，因间质性肾炎。需要进行肾脏移植，其兄自愿捐赠，体检后肾脏符合移植标准，但左肾功能较右肾功能稍差，其主治医师评估后将其左肾移植给患者，主治医师决策依据的原则是
A. 自愿
B. 患者健康至上
C. 唯一性
D. 保护供者
E. 知情同意

正确答案：D。保护供者

解析：我国人体器官移植的伦理原则：（－）患者利益至上原则（二）自愿无偿禁止买卖原则（三）知情同意原则（四）尊重和保护供体原则（五）保密原则（六）公平、公正、公开原则。本题将供者的功能较好的肾保留，符合保护供者的原则（D对）。